男，36岁，急性化脓性阑尾炎5天，未行手术治疗。今日出现高热、寒战，右季肋区疼痛。查体：T39℃，皮肤巩膜轻度黄染，肝区叩痛（+）。实验室检查：ALT、AST，总胆红素均轻度升高。腹部B超提示肝脏可见一个液性暗区＞2㎝。进一步的检查是
A. 穿刺抽液
B. 腹部CT
C. 静脉胆道造影
D. 腹部X线平片
E. 肝功能检测

正确答案：A。穿刺抽液

解析：男，36岁，急性化脓性阑尾炎5天，未行手术治疗。今日出现高热、寒战，右季肋区疼痛（提示感染）。查体：T39℃，皮肤巩膜轻度黄染，肝区叩痛（+）。实验室检查：ALT、AST，总胆红素均轻度升高（肝功能障碍）。腹部B超提示肝脏可见单个液性暗区，综上考虑诊断为急性阑尾炎延误治疗导致的细菌性肝脓肿，此时应施行穿刺抽液细菌培养予以确诊（A对）。